紫菀的功效是
A. 温肺化痰止咳
B. 清肺化痰止咳
C. 润肺化痰止咳
D. 宣肺化痰止咳
E. 敛肺化痰止咳

正确答案：C。润肺化痰止咳

解析：本题考查紫菀的功效，记忆即可。紫菀具有润肺化痰止咳的功效（C对）。可用于咳嗽有痰。凡咳嗽之证，无论外感、内伤，病程长短，寒热虚实，皆可用之。